患者，女，15岁。水肿3个月余，下肢为甚，按之凹陷不易恢复，心悸，气促，腰部冷痛，尿少，四肢冷，舌质淡胖，苔白，脉沉。其证候是
A. 湿毒浸淫
B. 湿热壅盛
C. 脾阳虚衰
D. 水湿浸渍
E. 肾气衰微

正确答案：E。肾气衰微

解析：腰膝以下，肾气主之，肾气虚衰，阳不化气，水湿下聚，故见下肢肿甚，按之凹陷不易恢复；水气上凌心肺，故心悸，气促；腰为肾之府，肾虚而水气内盛，故腰痛酸重；肾与膀胱相表里，肾阳不足，膀胱气化不行，故尿少；肾阳亏虚，命门火衰，不能温阳，故四肢冷；舌质淡胖，苔白，脉沉均为阳气虚衰，水湿内盛之候。故辩证为水肿阴水之肾气衰微证（E对）。湿毒浸淫证以眼睑浮肿，延及全身，皮肤光亮，尿少色赤，身发疮痍，甚则溃烂，恶风发热等症为特征（A错）。湿热壅盛证以遍体浮肿，皮肤绷急光亮，胸脘痞闷，烦热口渴，小便短赤，或大便干结等症为特征（B错）。脾阳虚衰证以身肿日久，腰以下为甚，按之凹陷不易恢复，脘腹胀闷，纳减便溏，面色不华，神疲乏力，四肢倦怠，小便短少等症为特征（C错）。水湿浸渍证以全身水肿，下肢明显，按之没指，小便短少，身体困重，胸闷，纳呆，泛恶等症为特征（D错）。